《中国药典》，应检查二氧化硫残留量的药材有
A. 山药
B. 天冬
C. 牛膝
D. 天麻
E. 天花粉

正确答案：A、B、C、D、E。山药；天冬；牛膝；天麻；天花粉

解析：本题考查的是本题考查外源性有害物质及检测。《中国药典》，应检查二氧化硫残留量的药材有山药（A对）、天冬（B对）、牛膝（C对）、天麻（D对）与天花粉（E对）。有的中药材在加工或储藏中常使用硫黄熏蒸以达到杀菌防腐、漂白药材的目的。《中国药典》用酸碱滴定法、气相色谱法、离子色谱法分别作为第一法、第二法、第三法测定经硫黄熏蒸处理过的药材或饮片中二氧化硫的残留量。规定二氧化硫残留量不得过400mg/kg的药材和饮片有：毛山药、光山药、天冬、天花粉、天麻、牛膝、白及、白术、白芍、党参、粉葛等。山药片不得过10mg/kg。